医疗机构第二类精神药品处方保存期限至少为
A. 1年
B. 2年
C. 4年
D. 3年

正确答案：B。2年

解析：本题考查医疗机构的处方管理。医疗机构第二类精神药品处方保存期限至少为2年（B对）。医疗机构应当对麻醉药品和精神药品处方进行专册登记，加强管理。麻醉药品处方至少保存3年（D错），精神药品处方至少保存2年。